胃肠平滑肌收缩的幅度主要取决于
A. 动作电位的幅度
B. 动作电位的频率
C. 基本电节律的幅度
D. 基本电节律的频率
E. 静息电位的幅度

正确答案：B。动作电位的频率